患者，男，32岁。素日嗜酒，外出着凉后，始见时时振寒，发热，继而壮热汗出，烦躁不宁，咳嗽气急，咳吐腥臭浊痰，胸满作痛，口干苦，便秘，舌红苔黄腻，脉滑数。治疗应首选
A. 清金化痰汤
B. 如金解毒散
C. 桑白皮汤
D. 加味泻白散
E. 《济生》桔梗汤

正确答案：B。如金解毒散

解析：患者以咳吐腥臭浊痰为主诉，故诊断为肺痈；邪热由表入里，热毒内盛，正邪交争，故壮热、振寒、汗出、烦躁；热毒壅肺，肺气上逆，肺络不利，则咳嗽气急，胸满作痛，转侧不利；痰浊瘀热，郁蒸成痈，则咳吐浊痰，呈黄绿色，自觉喉中有腥味；热邪耗津伤液，故口干咽燥；痰热内盛，故苔黄腻，脉滑数，故当属于成痈期，治以清肺解毒，化瘀消痈，代表方为千金苇茎汤合如金解毒散，根据最佳选项的原则，选如金解毒散降火解毒，清肺消痈（B对）。清金化痰汤，其功用为清热化痰，可用于内伤咳嗽之痰热郁肺证（A错）。桑白皮汤，其功用为清热化痰，宣肺平喘，可用于喘证之痰热郁肺证（C错）。加味泻白散，不同方药治疗不同病证，如小儿肺炎喘嗽、鼻痣、咳嗽之肝火犯肺证等（D错）。《济生》桔梗汤，其功用为清肺化痰，排脓泄壅，可用于肺痈之溃脓期（E错）。